最小二乘法原理是指各实测点距回归直线的
A. 垂直距离相等
B. 垂直距离的和最小
C. 垂直距离的平方和最小
D. 纵向距离之和最小
E. 纵向距离平方和最小

正确答案：E。纵向距离平方和最小